正常人的开口度为
A. 3.7～4.5cm
B. 4.7～5.5cm
C. 2.7～3.5cm
D. 5.5～6.5cm
E. 1.5～2.5cm

正确答案：A。3.7～4.5cm

解析：本题考查开口度。正常人的开口度为37～45mm（3.7～4.5cm）（A对），低于该值（CE错）表明有张口受限，大于该值（BD错）表明开口过度。